与青霉素G比较，红霉素的特点是
A. 属繁殖期杀菌剂
B. 抗菌效力强
C. 对绿脓杆菌感染有效
D. 对伤寒、副伤寒有效
E. 对抗药金黄色葡萄球菌感染有效

正确答案：E。对抗药金黄色葡萄球菌感染有效

解析：红霉素属于大环内脂类抗菌药，对革兰阳性菌的金黄色葡萄球菌包括耐药的金黄色葡萄球菌（E对）、表皮葡萄球菌、链球菌作用强，对部分格兰阴性菌如脑膜炎奈瑟菌、淋病奈瑟菌、流感杆菌、军团菌等高度敏感，对绿脓杆菌感染无效（C错）。青霉素G与红霉素抗菌作用都很强（B错），青霉素G在细菌繁殖期低浓度抑菌，较高浓度杀菌。一般将抗菌药物作用性质分为四大类。第一类为繁殖期杀菌药如青霉素G等β-内酰胺类抗生素；第二类为静止期杀菌药如氨基糖苷、多粘菌素类抗生素，他们对静止期、繁殖期细菌均有杀菌作用；第三类为快速抑菌药，如四环素、大环内脂类（A错）；第四类为慢速抑菌药如磺胺类药物等。伤寒、副伤寒首选氟喹诺酮类或第三代头孢菌素（D错），具有速效、低毒、复发少和愈后不带菌等特点。